便秘发生率最高的降压药是
A. 氢氯噻嗪
B. 维拉帕米
C. 氯沙坦
D. 普萘洛尔
E. 卡托普利

正确答案：B。维拉帕米